早产的常见病因是
A. 遗传因素
B. 下生殖道感染
C. 头盆不称
D. 孕激素水平升高
E. 胎儿畸形

正确答案：B。下生殖道感染

解析：早产主要分为自发性早产和治疗性早产，前者又可分为胎膜完整早产和未足月胎膜早破。常见类型为胎膜完整早产主要机制为宫腔过度紧张、母胎应激反应、宫内感染，其中宫内感染多由下生殖道感染逆行而上引起（B对）。遗传因素（A错）、头盆不称（C错）、孕激素水平升高（D错）、胎儿畸形（E错）会引起早产但不是主要因素。